不是硒的毒作用机制的是
A. 自由基形成
B. 酶活性抑制
C. S-腺苷蛋氨酸耗损
D. 产生活性氧
E. 遗传性状突变

正确答案：E。遗传性状突变

解析：本题考查硒的毒作用机制。有关硒的毒作用机制可概括归纳为以下两个方面：1.自由基形成学说（A对）：实验研究证实，亚硒酸盐（SeO²⁻）与谷胱甘肽反应，可产生硒化氢（H₂Se）；与氧反应可产生超氧阴离子或其他形式的活性氧，上述物质均可引起过氧化损伤。扫描电镜观察发现，亚硒酸钠和硒半胱氨酸均能破坏体外培养的红细胞膜，并认为可能是自由基所导致。利用扩大化学发光技术，证实了亚硒酸盐与L-半胱氨酸反应亦能产生超氧化物；同时利用鲁米诺放大发光技术发现，在上述反应中确能产生H₂O₂。体内实验也证实，硒蛋氨酸可通过胱硫醚途径转变为单质硒，而单质硒可与谷胱甘肽反应最终形成Se²⁻。据此，有人推断组织中的硒蛋氨酸具有产生活性氧的潜能（D对）。2.硒对酶活性的抑制（B对）：研究证明，硒能抑制生物氧化过程中的某些脱氢酶活性。脱氢酶体系中的许多酶结构中富含巯基，当大量的硒化物进入体内后，可取代巯基，从而使酶失去活性。硒化物与巯基结合后，形成三硫化物硒，其结果使以巯基作为功能基团的酶激活受阻，从而干扰细胞的正常生物氧化和蛋白质、脂肪合成过程。另外，在无机硒代谢转化（解毒）过程中，需要消耗大量S-腺苷蛋氨酸为其提供甲基，才能形成毒性相对较低的二甲基硒化合物。S-腺苷蛋氨酸是生化代谢中重要的甲基供体，可为许多物质的生物转化提供甲基。由于硒的毒性作用，使S-腺苷蛋氨酸大最耗损（C对），亦可妨碍细胞正常生化代谢过程。遗传性状突变（E错，为本题正确答案）不是硒的毒作用机制。